胰头癌伴梗阻性黄疸时，查体的特点是
A. 胆囊表面光滑，伴局部肌紧张
B. Murphy征阳性
C. 胆囊表面不平，压痛明显：
D. 胆囊表面不平，无压痛
E. 胆囊表面光滑，无压痛

正确答案：E。胆囊表面光滑，无压痛

解析：胰头癌伴梗阻性黄疸时，查体的特点是胆囊表面光滑，无压痛（E对C错）。胰头癌癌肿压迫或浸润胆总管，导致胆总管进行性梗阻，出现黄疸及无痛性胆囊增大，称为Courvoisier征阳性。由于胆囊肿大是由胆汁淤积所致，故胆囊表面光滑。Murphy征阳性（B错）见于急性胆囊炎；胆囊表面不平，无压痛（D错）见于胆囊癌。